一项1∶1配比病例对照研究，共调查240对，病例和对照均有某种暴露史60对，均无某种暴露史75对，病例有某种暴露史、对照无某种暴露史70对，对照有某种暴露史、病例无某种暴露史35对。其OR值为
A. 1.7
B. 1.3
C. 0.5
D. 0.9
E. 2

正确答案：E。2